与硝酸银反应生成银盐，用于烧伤、烫伤创面的抗感染药为
A. 磺胺嘧啶
B. 头孢氨苄
C. 甲氧苄啶
D. 青霉素钠
E. 氯霉素

正确答案：A。磺胺嘧啶

解析：本题考查磺胺嘧啶。磺胺嘧啶（A对）可以与硝酸银反应制成银盐，预防和治疗重度烧伤的感染。头孢氨苄（B错）为β-内酰胺类抗生素，具有较强的杀菌效应。甲氧苄啶（C错）为抗菌增效剂。青霉素钠（D错）是天然的抗菌药。氯霉素（E错）是酰胺醇类抗生素。